2015年联合国可持续发展峰会制定了“2030年可持续发展议程”，以下关于该议程的目标中错误的是
A. 到2030年，全球孕产妇每10万例活产的死亡串降至70人以下
B. 到2030年，通过预防、治疗及促进身心健康，将非传染性疾病导致的过早死亡减少2/3
C. 到2020年，全球公路交通事故造成的死伤人数减半
D. 到2030年，大幅减少危险化学品以及空气、水和土壤污染导致的死亡和患病人数
E. 到2030年，确保普及性健康和生殖健康保健服务

正确答案：B。到2030年，通过预防、治疗及促进身心健康，将非传染性疾病导致的过早死亡减少2/3